桃仁是常用的活血药，其药理作用有
A. 抗炎
B. 镇痛
C. 镇咳
D. 抗凝血
E. 兴奋子宫

正确答案：A、B、C、D、E。抗炎；镇痛；镇咳；抗凝血；兴奋子宫

解析：本题考查的是桃仁的药理作用。桃仁是常用的活血药，其药理作用有抗炎（A对）、镇痛（B对）、镇咳（C的）、抗凝血（D对）、兴奋子宫（E对）。桃仁药理作用：1.对心血管系统的作用（1）对血管、血压、血流量的影响：桃仁有扩张血管、减少血管阻力、增加血流量、降低心肌耗氧量、改善微循环的作用。（2）抗血栓作用：抑制血小板聚集。2.镇痛、镇静作用3.抗炎作用4.兴奋子宫作用。